牡蛎散中功专止汗的药物是
A. 煅牡蛎
B. 麻黄根
C. 生黄芪
D. 小麦
E. 山茱萸

正确答案：B。麻黄根

解析：牡蛎散方中煅牡蛎咸涩微寒，敛阴潜阳，固涩止汗，为君药。生黄芪味甘微温，益气实卫，固表止汗，为臣药。君臣相配，是为益气固表、敛阴潜阳的常用组合。麻黄根甘平，功专收敛止汗，为佐药（B对）。小麦甘凉，专入心经，养气阴，退虚热，为佐使药。